关于药品经营管理的说法，错误的是
A. 《药品经营许可证》变更分为许可事项变更和登记事项变更
B. 药品监督管理部门应当对药品经营企业进行监督检査，促使其持续符合法定要求
C. 药品经营企业的法定代表人、企业负责人对本企业的药品经营活动全面负责
D. 国家对药品经营实施许可制度，药品上市许可持有人自行销售药品的，必须取得《药品经营许可证》

正确答案：D。国家对药品经营实施许可制度，药品上市许可持有人自行销售药品的，必须取得《药品经营许可证》

解析：本题考查的是药品上市许可持有人的权利和义务。药品上市许可持有人从事药品零售活动的，应当取得药品经营许可证（D错，为本题正确答案）。药品上市许可持有人依法自行销售或委托销售药品：药品上市许可持有人可以自行销售其取得药品注册证书的药品，也可以委托药品经营企业销售。药品上市许可持有人从事药品零售活动的，应当取得药品经营许可证。药品上市许可持有人自行销售药品的，应当具备本法第五十二条规定的条件；委托销售的，应当委托符合条件的药品经营企业。药品上市许可持有人和受托经营企业应当签订委托协议，并严格履行协议约定的义务。药品经营许可证变更分为许可事项变更和登记事项变更（A对）。《药品管理法》规定，药品监督管理部门应当依照法律、法规的规定对药品研制、生产、经营和药品使用单位使用药品等活动进行监督检查，药品监督管理部门应当对药品上市许可持有人、药品生产企业、药品经营企业和药物非临床安全性评价研究机构、药物临床试验机构等遵守药品生产质量管理规范、药品经营质量管理规范、药物非临床研究质量管理规范、药物临床试验质量管理规范等情况进行检查，监督其持续符合法定要求（B对）。药品安全的第一责任人：药品上市许可持有人在享有依法从事药品研制、生产、经营，享受鼓励性支持性政策的权利同时，应当依照《药品管理法》的规定，对药品的非临床研究、临床试验、生产经营、上市后研究、不良反应监测及报告与处理等承担责任。其他从事药品研制、生产、经营、储存、运输、使用等活动的单位和个人依法承担相应责任。药品上市许可持有人的法定代表人、主要负责人对药品质量全面负责（C对）。药品上市许可持有人为境外企业的，应当由其指定的在中国境内的企业法人履行药品上市许可持有人义务，与药品上市许可持有人承担连带责任。